卵巢浆液性囊腺瘤
A. 是最常见的卵巢良性肿瘤
B. 有恶性程度的逆转倾向
C. hCG升高
D. CA125升高
E. 具有男性化作用

正确答案：D。CA125升高

解析：80%的卵巢浆液性瘤血清CA125水平升高（D对），多用于病情监测和疗效评估。浆液性囊腺瘤占卵巢良性肿瘤25%（A错）。最常见的卵巢良性肿瘤为成熟畸胎瘤，占卵巢肿瘤10%～20%。有恶性程度的逆转倾向的是未成熟畸胎瘤（B错）。hCG升高（C错）提示早期妊娠或滋养细胞肿瘤如葡萄胎、恶性葡萄胎、绒毛膜上皮癌及睾丸畸胎瘤，还对非妊娠性卵巢绒癌有特异性。具有男性化作用（E错）的是支持细胞-间质细胞肿瘤，又称睾丸母细胞瘤。